女，65岁。间断咳嗽咳痰10年，加重伴呼吸困难2天。血气分析：pH7.35，PaO₂56mmHg，PaCO₂46mmHg。给予该患者鼻导管吸氧治疗。如需使用的吸氧浓度为27%，则其氧流量应调整为
A. 1.0L/min
B. 1.5L/min
C. 2.0L/min
D. 2.5L/min
E. 3.0L/min

正确答案：B。1.5L/min

解析：患者为老年女性，间断咳嗽、咳痰10年（为慢阻肺的典型表现），考虑诊断为慢性阻塞性肺疾病。吸入氧浓度与氧流量的公式为：吸入氧浓度（%）=21+4×氧流量（L/min）。将题干所给数据代入公式，27%=21+4×氧流量（L/min），计算得氧流量=1.5L/min，则其氧流量应调整为1.5L/min（B对ACDE错）。